女，75岁。10小时前出现胸骨后疼痛，逐渐加重，休息后不缓解。2小时前逐渐出现呼吸困难，咳少量泡沫样痰。查体：端坐位，口唇轻度发绀，心电图示V1~V6导联QRS波型正常，ST段抬高0.3mV。该患者最可能出现的体征还有
A. 三凹征
B. 双肺湿啰音
C. 肝肿大
D. 下肢水肿
E. 颈静脉怒张

正确答案：B。双肺湿啰音

解析：患者中老年女性，10小时前出现胸骨后疼痛，逐渐加重，休息后不缓解（心肌梗死症状）。2小时前逐渐出现呼吸困难，咳少量泡沫样痰（急性左心衰症状）。查体：端坐位，口唇轻度发绀，心电图示V1～V6导联QRS波型正常，ST段抬高0.3mv（急性ST段抬高型心肌梗死典型心电图）。据患者临床表现及心电图提示，最有可能的诊断是急性ST段抬高型心肌梗死合并左心衰竭。患者急性心肌梗死，心肌收缩力明显降低，心脏负荷加重，造成急性心排血量骤降、肺循环压力突然升高，出现急性肺淤血，如肺部湿啰音（B对）、发绀，甚至咳粉红色泡沫痰等症状。三凹征（A错）指吸气时胸骨上窝、锁骨上窝、肋间隙出现明显凹陷，常见于气管异物、喉水肿等。肝肿大（C错）、下肢水肿（D错）、颈静脉怒张（E错）均是右心衰竭的体循环表现。